在皮肤刺激试验中最好使用
A. 小鼠和大鼠
B. 大鼠和家兔
C. 家兔和小鼠
D. 豚鼠和家兔
E. 地鼠和豚鼠

正确答案：D。豚鼠和家兔